在纵向磨片中，观察到在牙尖部分的釉质生长线呈
A. 树丛形
B. 环形
C. 线形
D. 直线形
E. 水波形

正确答案：B。环形

解析：釉质生长线在纵向磨片中，生长线自釉牙本质界向外，沿着釉质形成的方向，在牙尖部呈现环形排列包绕牙尖。掌握“牙釉质”知识点。